用一种筛检乳腺癌的试验，对400例患有乳腺癌的妇女和400名正常妇女进行筛检，结果前者中80例阳性，后者中40例阳性。该试验的阳性似然比为
A. 0.5
B. 5
C. 4
D. 10
E. 2

正确答案：E。2

解析：根据表6-2 评价试验的整理表，该实验中病例数（a+c）为400例患有乳腺癌的妇女，a为80例阳性的患有乳腺癌的妇女，可得c为320名阴性的患有乳腺癌的妇女，非病例数（b+d）为400名正常妇女，b为40例阳性的正常妇女，可得d为360名阴性的正常妇女。根据以上数据，结合特异度计算公式，可以得出特异度=d/b+d ×100%=90%，假阳性率=b/b+d ×100%=10%，灵敏度= a/a+c ×100%=20%，假阴性率= c/a+c ×100%=80%。因此根据阳性似然比的计算公式可得：阳性似然比＝真阳性率/假阳性率=灵敏度/1-特异度=2（E对）。